基础代谢相对较高的正常成人人群特点是
A. 体型矮胖
B. 体型瘦高
C. 老年
D. 女性
E. 居住在南方

正确答案：B。体型瘦高